男性，30岁。十二指肠溃疡史5年。今日突然呕血伴休克。应首先采取的抢救措施是
A. 补充血容量
B. 口服去甲肾上腺素水
C. 静脉滴注止血敏
D. 静滴甲氰咪呱
E. 冰水洗胃

正确答案：A。补充血容量

解析：患者青年男性，因十二指肠溃疡而发生上消化道出血，出现休克，首先采取的抢救措施是补充血容量（A对）。口服去甲肾上腺素水（B错）能收缩胃黏膜血管；静脉滴注止血敏（C错）能促进血小板聚集；静滴甲氰咪呱（D错）能抑制胃酸分泌；冰水洗胃（E错）能降低动脉血流量、减少胃蠕动；以上四种措施均有助于止血，但其重要性不及抗休克、补充血容量治疗。